氯丙嗪作用机制为
A. 对心肌有奎尼丁样作用
B. 使突触间隙的NA浓度下降
C. 阻断N胆碱受体
D. 阻断D₁、D₂受体
E. 阻断中枢5-HT受体

正确答案：D。阻断D₁、D₂受体

解析：氯丙嗪主要通过阻断脑内边缘系统多巴胺受体（D1、D2受体）而发挥抗精神病作用（D对）。使突触间隙的NA浓度下降（B错），即通过摄取突触间隙中儿茶酚胺并增加其灭活是碳酸锂抗躁狂药的治疗机制之一。阻断N胆碱受体（C错），是神经节阻断剂和骨骼肌松弛剂（除极化型肌松药琥珀胆碱和非除极化型肌松药筒箭毒碱）的作用机制。对心肌有奎尼丁样作用（A错）是丙咪嗪对心血管系统的直接抑制效应，故心血管病患者慎用。阻断中枢5-HT受体（E错），是用于治疗抗肿瘤药物诱发的呕吐即昂丹司琼等5-HT受体拮抗剂的作用机制。